患者暴食后突然发生上腹持续疼痛，恶心，呕吐，发热。检查：腹部较软，有压痛，反跳痛不明显，血清淀粉酶增高。其诊断是
A. 急性肠梗阻
B. 急性胃肠炎
C. 急性胆囊炎
D. 急性胰腺炎
E. 消化性溃疡急性穿孔

正确答案：D。急性胰腺炎

解析：患者暴食后突然发生上腹持续疼痛，恶心，呕吐，发热。检查：腹部较软，有压痛，反跳痛不明显，血清淀粉酶增高，符合急性胰腺炎的诊断标准，故可诊断为急性胰腺炎（D对）。急性肠梗阻（A错）上腹部绞痛，腹部较硬，胃肠蠕动减慢，X线检查有气液平面。急性胃肠炎（B错）特点是上吐下泻，腹痛，食欲减退。急性胆囊炎（C错）的特点为厌食油腻食物，上腹疼痛，墨菲征阳性。消化性溃疡急性穿孔（E错）表现为全腹疼痛，发热，板状腹，压痛、反跳痛均较明显。均不会表现为血清淀粉酶升高。